属于医学伦理学基本原则的是
A. 有利、公正
B. 权利、义务
C. 廉洁奉公
D. 医乃仁术
E. 等价交换

正确答案：A。有利、公正